肝蒂内主要结构排列的位置，由前向后是
A. 肝左、右管，肝门静脉左、右支，肝固有动脉左、右支
B. 肝固有动脉左、右支，肝左、右管，肝门静脉左、右支
C. 肝左、右管，肝固有动脉左、右支，肝门静脉左、右支
D. 肝门静脉左、右支，肝左、右管，肝固有动脉左、右支
E. 肝固有动脉左、右支，肝门静脉左、右支，肝左、右管

正确答案：C。肝左、右管，肝固有动脉左、右支，肝门静脉左、右支

解析：肝蒂内主要结构排列位置，从前向后为肝左、右管，肝固有动脉左、右支，肝门静脉左、右支(C对)。